妊娠与心脏病的相互影响中错误的是
A. 妊娠激素变化可以部分对抗心衰
B. 妊娠期血容量增加，心排出量增加，心率加快
C. 妊娠显著加大心脏负担
D. 子宫增大，机械性增加心脏负担，更易发生心力衰竭
E. 治疗要预防及治疗心衰，适时终止妊娠

正确答案：A。妊娠激素变化可以部分对抗心衰

解析：妊娠期，为了适应母儿的需要，妊娠期血容量增加、心排出量加大、心率加快（B对），心脏负担加重，至妊娠32～34周达到高峰，妊娠晚期子宫增大，膈肌上升，心脏位置改变，大血管扭曲，也导致心脏负担加重（C对）。故妊娠易致心脏病加重，甚至发生心衰（D对）。分娩期是心脏负担最重的时期。子宫收缩时，子宫血液被挤入体循环，回心血量增加，外周阻力增加；第二产程时，除宫缩外，产妇屏气用力，腹壁肌和骨骼肌同时收缩，使周围循环、肺循环阻力加大，心脏负担进一步加重；第三产程时，因胎儿娩出腹压骤减，血液流向内脏，回心血量减少。这样均易使心脏功能不良者发生心衰。治疗时应预防及治疗心衰，适时终止妊娠（E对）（A错，为本题正确答案）。